能量储存的主要形式是
A. 蛋白质
B. 糖
C. 脂肪
D. 淀粉
E. 脂肪酸

正确答案：C。脂肪